患者，女，35岁。胃脘部隐痛，痛处喜按，空腹痛甚，纳后痛减，伴胃脘灼热，似饥而不欲食，咽干口燥，大便干结，舌红少津，脉弦细。治疗应首选
A. 内关、天枢、中脘、膈俞
B. 内关、足三里、中脘、胃俞
C. 内关、天枢、中脘、太冲
D. 内关、足三里、中脘、下脘、梁门
E. 足三里、中脘、内关、三阴交、内庭

正确答案：E。足三里、中脘、内关、三阴交、内庭

解析：该患者以胃脘部隐痛，痛处喜按，空腹痛甚，纳后痛减为主症，故诊断为胃痛。隐痛，痛处喜按，空腹痛甚，纳后痛减，故为虚证，胃脘灼热，似饥而不欲食，咽干口燥，大便干结，舌红少津，脉弦细均为胃阴不足之象，故辨为胃阴不足证。胃痛治宜和胃止痛，以足阳明、手厥阴经穴及相应募穴为主。主穴为中脘、内关、足三里，各证型均可选用。内关、天枢、中脘、膈俞为胃痛气滞血瘀证的配穴（A错）。胃阴不足、寒邪犯胃、肝气犯胃证均可在主穴的基础上配胃俞，故非首选（B错）。内关、天枢、中脘、太冲为肝气犯胃证的配穴（C错）。内关、足三里、中脘、下脘、梁门为饮食停滞证的配穴（D错）。胃阴不足证可配胃俞、三阴交、太溪，内庭穴能清胃热，化积滞，亦可选用（E对）。